关于细菌内毒素的描述，不正确的是
A. 由革兰阴性菌裂解产生
B. 化学成分为脂多糖
C. 毒性较弱且无特异性
D. 耐热，160℃，2～4小时才被破坏
E. 抗原性强，经甲醛处理可制成类毒素

正确答案：E。抗原性强，经甲醛处理可制成类毒素

解析：内毒素产生于革兰阴性菌细胞壁，化学成分为脂多糖（LPS）组分（B对），只有在细菌死亡裂解后才被释放出来（A对），其作用相对较弱且对组织无选择性（C对），内毒素的对理化因素稳定，加热160℃2～4小时才被灭活（D对），但抗原性弱，不能用甲醛液脱毒而成为类毒素（E错，为本题正确答案）。